能疏肝的药是
A. 麦芽
B. 槟榔
C. 莱菔子
D. 鸡内金
E. 南瓜子

正确答案：A。麦芽

解析：本题考查的是麦芽的功效。能疏肝的药是麦芽（A对）。麦芽：【功效】消食和中，回乳，疏肝。槟榔（B错）：【功效】杀虫，消积，行气，利水，截疟。莱菔子（C错）：【功效】消食除胀，降气化痰。鸡内金（D错）：【功效】运脾消食，固精止遗，化坚消石。南瓜子（E错）：【功效】杀虫。